以玉米为主食的地区易发生
A. 脂溢性皮炎
B. 癞皮病
C. 脚气病
D. 佝偻病
E. 白内障

正确答案：B。癞皮病